为了解5年内城市人口高血压的患病情况，随机抽取城市人口的15%进行调查，为防止调查产生偏性，下列措施不正确的是
A. 对于那些检查血压时不肯合作的人应以较合作的人代替
B. 对5年内死亡的调查人群的成员应追踪其死亡是否与高血压有关
C. 应当使用统一的血压计
D. 应反复多次对调查人群观察、测量
E. 对5年期间调查人群中搬出该城市的那部分人应尽量查明新地址继续测量他们的血压变化情况

正确答案：A。对于那些检查血压时不肯合作的人应以较合作的人代替

解析：题目中所述的调查过程可能产生选择偏倚、失访偏倚、信息偏倚等多种偏倚，因题目中所述的调查时间较长，故调查对象的失访很常见，失访即调查对象因对调查不感兴趣、或移居外地、或因其它原因死亡等原因而退出调查。对5年内死亡的调查人群的成员应追踪其死亡是否与高血压有关来判断调查对象是否为失访，如调查人群是因高血压死亡则不可视为失访（B对）。对于失访者需要进行补访，对5年期间调查人群中搬出该城市的那部分人应尽量查明新地址继续测量他们的血压变化情况（E对）。使用统一的血压计（C对）及反复多次对调查人群观察、测量（D对）均属于防止调查产生测量偏倚的措施。调查人群一经确定后，不应随意改变，对于那些检查血压时不肯合作的人应以较合作的人代替可能会增加调查的选择偏倚（A错，为本题正确答案）。